内囊
A. 在大脑半球的水平切面呈“><”形
B. 位于豆状核和尾状核之间
C. 可分为前肢、中肢和后肢三部分
D. 位于豆状核与背侧丘脑之间
E. 每个部分均有上下行的投射纤维通过

正确答案：A。在大脑半球的水平切面呈“><”形

解析：内囊是位于丘脑、尾状核和豆状核之间（BD错）的白质板，在大脑半球的水平切面呈“><”形（A对），分前肢、膝部和后肢三部分（C错）。内囊三部分均有投射纤维通过，但其中内囊膝部只有下行的皮质核束纤维通过（E错）。